CTX的副作用不包括
A. 骨髓抑制
B. 化脓性膀胱炎
C. 恶心呕吐
D. 诱发移行细胞癌
E. 肝功能下降

正确答案：B。化脓性膀胱炎

解析：CTX即环磷酰胺是烷化剂抗恶性肿瘤药物，其不良反应有恶心呕吐（C对）腹泻、脱发，最主要的毒性反应为骨髓抑制（A对）和出血性膀胱炎而不是化脓性膀胱炎（B错，为本题正确答案），也可引起肝脏毒性出现肝功能下降（E对），很多抗肿瘤药物特别是烷化剂具有致突变和致癌性，以及免疫抑制作用，在化疗并获得长期生存的患者中，可能部分会发生与化疗相关的第二原发恶性肿瘤（D对）。